某女，33岁。浮肿1年，腰以下为甚，按之凹陷，不易恢复，脘腹胀闷，纳少，面色不华，神疲乏力，四肢倦怠，畏寒，小便短少，大便溏薄；舌淡苔白腻，脉沉缓。诊断为水肿。应采用的治法是
A. 疏风清热，宣肺行水
B. 宣肺解毒，利湿消肿
C. 温肾助阳，化气行水
D. 温阳健脾，行气利水
E. 分利湿热，化气行水

正确答案：D。温阳健脾，行气利水

解析：本题考查的是水肿的辨证论治。某女，33岁。浮肿1年，腰以下为甚，按之凹陷，不易恢复，脘腹胀闷，纳少，面色不华，神疲乏力，四肢倦怠，畏寒，小便短少，大便溏薄；舌淡苔白腻，脉沉缓。诊断为水肿。应采用的治法是温阳健脾，行气利水（D对）。水肿是体内水液潴留，泛滥肌肤，表现以头面、眼睑、四肢、腹背，甚至全身浮肿为特征的疾病。西医学中各种原因引起的水肿，如急、慢性肾小球肾炎、肾病综合征、继发性肾小球疾病等，以及肝性水肿、心性水肿、营养不良性水肿、功能性水肿、内分泌失调引起的水肿等，可参考此内容辨证论治。（一）风水相搏证：【症状】眼睑浮肿，继则四肢及全身皆肿，来势迅速，多有恶寒、发热，肢节酸楚，小便不利等。偏于风热者，伴咽喉红肿疼痛，舌质红，脉浮滑数；偏于风寒者，兼恶寒，咳喘，舌苔薄白，脉浮滑或浮紧。【治法】疏风清热，宣肺行水（A错）。（二）水湿浸渍证：【症状】全身水肿，下肢明显，按之没指，小便短少，身体困重，胸闷，纳呆，泛恶。苔白腻，脉沉缓。起病缓慢，病程较长。【治法】健脾化湿，通阳利水。（三）湿热壅盛证：【症状】遍体浮肿，皮肤绷急光亮，胸脘痞闷，烦热口渴，小便短赤，或大便干结。舌红，苔黄腻，脉沉数或濡数。【治法】分利湿热。（四）脾阳虚衰证：【症状】身肿日久，腰以下为甚，按之凹陷不易恢复，脘腹胀闷，纳减便溏，面色不华，神疲乏力，四肢倦怠，小便短少。舌质淡，苔白腻或白滑，脉沉缓或沉弱。【治法】温阳健脾，行气利水。（五）肾阳衰微证：【症状】水肿反复消长不已，面浮身肿，腰以下甚，按之凹陷不起，尿量减少或反多，腰酸冷痛，四肢厥冷，怯寒神疲，面色㿠白，甚者心悸胸闷，喘促难卧，腹大胀满。舌质淡胖，苔白，脉沉细或沉迟无力。【治法】温肾助阳，化气行水（C错）。